比较下列食品，维生素B₂的良好来源是
A. 白菜
B. 牛奶
C. 大米
D. 动物肝脏
E. 鸡蛋

正确答案：D。动物肝脏